女，45岁。腹泻10年。精神紧张时加剧，排便前腹痛，排便后腹痛可缓解。大便为糊状，发病以来体重无明显变化。既往体健，平素进食好，睡眠差。查体：T36.5℃，P80次／分，R18次／分，BP120/80mmHg。未见皮疹，双肺呼吸音清，闻及干湿性啰音，心律齐。腹软，无压痛。最有可能的诊断是
A. 肠易激综合征
B. 克罗恩病
C. 慢性细菌性痢疾
D. 肠结核
E. 结肠癌

正确答案：A。肠易激综合征

解析：女性患者，腹泻10年。精神紧张加剧（和精神因素有关），排便后缓解且大便性状为糊状（无粘液脓血便），体检无异常，仅有腹痛和排便异常可考虑肠易激综合征（A对）。克罗恩病（B错）腹泻、腹痛体重下降是其常见症状，可见黏液血便。慢性细菌性痢疾（C错）大便形状为脓血便可以排除。肠结核（D错）除有右下腹或脐周、间歇发作、大便呈糊状的临床表现外还可表现为长期不规则低热、盗汗、消瘦。结肠癌（E错）多表现为血便或粪便隐血阳性。